无排卵性功血的治崩三法是
A. 塞流、澄源、复旧
B. 急则治其标，缓则治其本
C. 调理气血冲任
D. 虚者补之，实者泻之
E. 热者清之，逆则降之

正确答案：A。塞流、澄源、复旧

解析：无排卵性功血的治疗应根据其病情的轻重缓急，灵活运用塞流、澄源、复旧之法。塞流即止血，暴崩之际，急当止血防脱，具体运用止血方法时，要根据病因病性选择恰当的止血药，注意崩漏的不同，治崩宜固摄升提，不宜辛温行血，治漏宜养血行气，不可偏于固涩。澄源即辨证求因以治本，为治疗崩漏的重要阶段，血止或病缓时应针对病因施治，使崩漏得到根本上的治疗，塞流、澄源两法常同步进行。复旧即调理善后，是巩固崩漏治疗的重要阶段，临床上多采用补肾、扶脾或疏肝的方法，复旧更需兼顾澄源，并根据月经周期冲任胞宫阴阳气血的变化来调整月经周期。治崩三法既有区别，又有内在联系，临床上不能截然分开，需结合病情灵活应用（A对）。